女，27岁。劳累后心悸、气短5年，近一周间断咯血，无发热。查体：双颊紫红，口唇轻度发绀，颈静脉无怒张。两肺未闻及干湿啰音。心浊音界在胸骨左缘第三肋间向左扩大。心尖部局限性舒张期隆隆样杂音，第一心音亢进。肝脏不大，下肢无水肿。本病致死的主要原因是
A. 心功能不全
B. 心律失常
C. 肺栓塞
D. 亚急性感染性心内膜炎
E. 呼吸道感染

正确答案：A。心功能不全